女，8岁。剧烈运动后胸闷，气短2个月。查体：心前区未触及震颤，胸骨左缘2、3肋间闻及3/6级收缩期杂音，P₂亢进，固定分裂。最可能的诊断是
A. 动脉导管未闭
B. 单纯肺动脉瓣狭窄
C. 房间隔缺损
D. 中型室间隔缺损
E. 小型室间隔缺损

正确答案：C。房间隔缺损

解析：根据患儿的杂音特点：胸骨左缘2-3肋间闻及3/6级缩期喷射性杂音、P₂亢进固定分裂，应诊断为房间隔缺损（C对）。动脉导管未闭的杂音特征为胸骨左缘第二肋间连续机械样杂音（A错）。单纯肺动脉狭窄（B错）胸骨左缘上部有洪亮的Ⅳ/Ⅵ级以上喷射性收缩期杂音，第二心音分裂（而不是肺动脉第二心音固定分裂）。室间隔缺损（DE错）的杂音特征是胸骨左缘第3、4肋间响亮的全收缩期杂音，肺动脉第二心音正常或稍增强。